腹膜返折以上直肠癌早期淋巴转移的主要途径是
A. 向直肠上动脉旁淋巴结转移
B. 向腹股沟淋巴结转移
C. 向髂内淋巴结转移
D. 向直肠下动脉旁淋巴结转移
E. 向侧方淋巴结转移

正确答案：A。向直肠上动脉旁淋巴结转移

解析：腹膜返折以上的直肠癌属于上段直肠癌，上段直肠癌早期淋巴转移的主要途径是向直肠上动脉旁淋巴结转移（A对）。腹股沟淋巴结转移（B错）多见于齿状线附近的癌灶。经直肠下动脉旁淋巴结（D错）向髂内淋巴结转移（C错）是下段直肠癌侧方淋巴结转移（E错）的主要途径。